治疗酮症酸血症及糖尿病昏迷的药物是
A. 甲苯磺丁脲
B. 苯乙双胍
C. 普通胰岛素
D. 精蛋白锌胰岛素
E. 珠蛋白锌胰岛素

正确答案：C。普通胰岛素

解析：本题考查普通胰岛素。治疗酮症酸血症及糖尿病昏迷的药物是普通胰岛素（C对）。胰岛素可用于治疗各型糖尿病，尤其是1型糖尿病，是其最重要的治疗药物。主要用于以下情况∶①1型糖尿病；②2型糖尿病需迅速降低血糖至正常水平者的初始治疗；③经饮食控制或口服降血糖药物未能控制的2型糖尿病；④发生各种急性或严重并发症（如酮症酸中毒、非酮症性高渗性昏迷）的糖尿病；⑤合并重度感染、高热、妊娠、分娩及大手术等糖尿病。甲苯磺丁脲（A错）属于第一代磺酰脲类降糖药，主要用于单用饮食治疗不能控制的2型糖尿病。苯乙双胍（B错）为双胍类口服降糖药，临床主要用于肥胖的2型糖尿病或饮食控制未成功的患者。精蛋白锌胰岛素（D错）为长效胰岛素。珠蛋白锌胰岛素（E错）为中效胰岛素。